下列各项，不会导致渴不多饮的是
A. 阴虚津亏
B. 热入营血
C. 湿热内蕴
D. 寒湿内停
E. 痰饮内停

正确答案：D。寒湿内停

解析：患者无明显口渴的感觉，饮水也不多，提示津液未伤，多见于寒证、湿证。因寒、湿为阴邪，不耗伤津液，故口不渴（D错，为本题正确答案）。口干不欲饮，兼见五心烦热，颧红盗汗，舌红少苔，脉细数者，属阴虚证。因阴津亏虚，虚火内扰所致（A对）。温病见口渴而不多饮，身热夜甚，心烦不寐，舌质红绛者，为营分证。因热入营分，灼伤营阴，故见口渴；但邪热蒸腾营阴上潮于口，故不多饮（B对）。口渴不多饮，兼身热不扬，头身困重，胸闷纳呆，舌苔黄腻者，属湿热证。因湿热为患，热灼津伤，故见口渴；但湿邪内阻，郁蒸于内，故饮水不多（C对）。口渴喜热饮，饮入不多，或水入即吐者，属痰饮病。因脾胃阳虚，饮停胃肠，致津液输布障碍，阳气不能气化津液上承于口，故见口渴喜热饮；饮后水停胃肠更甚，胃失和降而上逆，故水入即吐（E对）。